药物分子结构中-CO0H官能团在红外吸收光谱中的特征吸收峰有
A. ν N-H 3750～3000cm⁻¹
B. ν O-H 3400～2400cm⁻¹
C. ν C=O 1900～1650cm⁻¹
D. ν C=C 1670～1500cm⁻¹
E. ν C-O 1300～1000cm⁻¹

正确答案：B、C、E。ν O-H 3400～2400cm⁻¹；ν C=O 1900～1650cm⁻¹；ν C-O 1300～1000cm⁻¹

解析：本题考查官能团化合物的红外吸收峰特征。-COOH含有O-H、C-O、C-O三种化学键，因此红外吸收光谱中的特征吸收峰有3个：νO-H 3400～2400cm⁻¹（B对）、νC-O 1900～1650cm⁻¹（C对）、νC-O 1300～1000cm⁻¹（E对）。